关于流行性感冒病毒下列哪项是正确的
A. 流行性感冒病毒属副黏液病毒
B. 分A、B、C三型
C. 甲型不变异
D. 丙型可感染人类及多种动物
E. 乙型主要侵犯婴幼儿和免疫力低下的人群

正确答案：B。分A、B、C三型

解析：感病毒自内向外依次为核心、基质蛋白和包膜三部分，其核心含有分阶段的单股负链RNA即病毒的遗传物质，根据核心蛋白不同的抗原性，将病毒分为甲（A）、乙（B）、丙（C）三型（B对），三型之间无交叉免疫；流感病毒系RNA病属，属正黏病毒科，而不是副黏液病毒（A错）；抗原变异是流感病毒显著的特征，人类感染的三种流感病毒中，以甲型流感病毒的变异性最强，因此甲型不变异（C错）错误；甲型流感能传染多种动物而不是丙型，所以丙型可传染人类及多种动物（D错）；流感病毒人群普遍易感，婴幼儿和免疫力低下的人群属于流感高位人群，三型均易感，并非只有乙型主要侵犯婴幼儿和免疫力低下的人群（E错）。